初生新生儿血红蛋白120g/L，红细胞4.0x10¹²/L，表明
A. 正常
B. 轻度贫血
C. 中度贫血
D. 重度贫血
E. 极重度贫血

正确答案：B。轻度贫血

解析：本题考查儿童营养的相关内容。新生儿轻度贫血（B对ACDE错）是指血红蛋白在120～144g/L，中度贫血是指血红蛋白在90～120g/L，重度贫血是指60～90g/L，极重度贫血是低于60g/L。